女，10岁。3周前患“感冒”。突然发热3天，38℃左右。眼睑及颜面部水肿。尿检红细胞6个/HP，尿蛋白定性（+++）。血压120/90mmHg。该患儿最有可能的诊断是
A. 急进性肾小球肾炎
B. 慢性肾小球肾炎
C. 急性肾小球肾炎
D. 慢性肾炎急性发作
E. IgA肾病

正确答案：C。急性肾小球肾炎

解析：患儿3周前有前驱感染，现出现水肿、镜下血尿、血压升高，尿蛋白阳性，可诊断为急性肾小球肾炎（C对）。由于未见肾功能不全表现，故不能诊断为急进性肾小球肾炎（A错）。未见肾炎病史，排除慢性肾小球肾炎（B错）和慢性肾炎急性发作（D错）。未见血尿，IgA肾病可能性小（E错）。